掌浅弓的描述，哪项错误
A. 由尺动脉末端和桡动脉掌浅支吻合而成
B. 位于指浅屈肌深面
C. 凸侧缘分出4大分支
D. 3条指掌侧总动脉
E. 1条小指尺掌侧动脉

正确答案：B。位于指浅屈肌深面

解析：掌浅弓由尺动脉的末端与桡动脉的掌浅支吻合而成（A对）。位于掌腕膜的深面（B错，为本题正确答案）。弓的凸侧缘分出4大分支（C对），为3条指掌侧总动脉（D对）和1条小指尺掌侧动脉（E对）。